荆芥的功效是
A. 发表通窍，胜湿止痛，止血
B. 发表止痉，消疮止泻
C. 祛风解表，透疹消疮，止血
D. 发表止痛，利水消肿
E. 消疮止泻，透疹止血

正确答案：C。祛风解表，透疹消疮，止血

解析：荆芥为解表药中发散风寒药，性味辛、微温，归肺、肝经，具有解表散风，透疹，消疮之效。经炮制后的荆芥炭具有收敛止血之功（C对）。